前列腺排泄管开口于
A. 尿道嵴
B. 尿道膜部
C. 前列腺小囊
D. 尿道球部
E. 精阜附近的黏膜上

正确答案：E。精阜附近的黏膜上

解析：精阜附近的黏膜上（E对）为前列腺排泄管开口处。